在四肢上，治痰最好的是
A. 足三里
B. 丰隆
C. 曲池
D. 手三里
E. 承山

正确答案：B。丰隆

解析：丰隆穴是足阳明胃经之络穴，别走于足太阴脾经，故可治脾胃二经疾患，针刺丰隆穴可通调脾胃气机，使气行津布，中土得运，湿痰自化。另丰隆穴首载于《灵枢》，具有调和胃气、祛湿化痰、通经活络、补益气血、醒脑安神等功效，尤被古今医学家所公认为治痰之要穴（B对）。